服药后宜多饮水的药品是
A. 微生态制剂
B. 胃黏膜保护剂
C. 磺胺类药物
D. 头孢菌类药物
E. 抗高血压药

正确答案：C。磺胺类药物

解析：本题考查服药后宜多饮水的药物。磺胺类药物（C对）主要由肾排泄，在尿液中的浓度高，易发生尿路刺激和阻塞现象，服用磺胺类药物时宜大量喝水，有助于以尿液冲走结晶性沉淀。胃黏膜保护剂（B错）服用后1小时内限制饮水，避免保护层被水冲掉。微生态制剂（A错）、头孢菌类药物（D错）、抗高血压药（E错）对饮水多少没有特殊要求。